全口义齿人工牙的排列主要要从哪三个方面考虑
A. 美观，坚固和发音
B. 美观，功能和组织保健
C. 美观，固位和稳定
D. 美观，发音，卫生和舒适
E. 美观，发音，稳定

正确答案：B。美观，功能和组织保健

解析：本题考查排牙的原则。全口义齿人工牙的排列最重要的是美观、功能和组织保健（B对）这三个方面。义齿在功能状态下的稳定，是组织保健的重要方面；功能主要指咀嚼功能；坚固、发音（A错）、固位（C错）、卫生、舒适（D错）、稳定（E错）等因素也需要考虑，但是美观、功能和组织保健是主要方面。